义齿修复前常需进行牙槽骨修整的部位不包括
A. 上颌结节
B. 上颌唇侧
C. 磨牙后垫
D. 下颌双尖牙舌侧
E. 拔牙创部位

正确答案：C。磨牙后垫

解析：本题考查修复前的外科处理。磨牙后垫（C错，为本题的正确选项）是全口义齿下颌基托的边缘封闭区，不可进行修整，以防破坏边缘封闭，影响义齿的固位和稳定。为了使全口义齿达到良好的功能效果和组织保健，有些患者需要在义齿修复前对无牙颌进行外科修整。两侧上颌结节（A对）较大，同时存在明显倒凹时，将影响义齿颊侧基托边缘的伸展和义齿的就位，此时应去除其颊侧（唇侧）（B对）骨突或至少去除较大一侧骨突。下颌双尖牙舌侧（D对）的骨突，即下颌隆突，该处覆盖黏膜较薄，过大、过突，在下方形成明显倒凹时需手术修整。拔牙创部位（E对）存在增生的骨突、骨尖妨碍义齿就位的也需要修整。